获得性膜的功能不包括
A. 修复或保护釉质表面
B. 为釉质提供有选择的渗透性
C. 影响特异性口腔微生物对牙面的附着
D. 作为菌斑微生物的底物和营养
E. 是牙齿防御系统的组成部分

正确答案：E。是牙齿防御系统的组成部分

解析：本题考查获得性膜的功能。获得性膜不是牙齿防御系统的组成部分（E错，为本题的正确答案），牙齿的防御功能主要依靠牙髓如牙髓的疼痛、第三期牙本质形成和炎症反应等。获得性膜的功能包括修复或保护釉质表面（A对）；为釉质提供有选择的渗透性（B对）；影响特异性口腔微生物对牙面的附着（C对）；作为菌斑微生物的底物和营养（D对）等。